氟中毒的论述中错误的是
A. 发病与性别无关
B. 氟斑牙多见于乳牙
C. 患氟斑牙不一定伴氟骨症
D. 氟骨症随年龄增加而增加
E. 氟骨症多发病于10岁以后

正确答案：B。氟斑牙多见于乳牙

解析：本题考查地方性氟中毒。地方性氟中毒是由于一定地区的环境中氟元素过多，而致生活在该环境中的居民经饮水、食物和空气等途径长期摄入过量氟所引起的以氟骨症和氟斑牙为主要特征的一种慢性全身性疾病。地方性氟中毒与年龄有密切关系，氟斑牙主要发生在正在生长发育中的恒牙，乳牙一般不发生氟斑牙（B错，为本题正确答案）。氟骨症多发病于10岁以后（E对），发病主要在成年人，发生率随着年龄增长而升高（D对），且病情严重。但是，患氟斑牙不一定伴氟骨症（C对）。地方性氟中毒的发生一般无明显性别差异（A对）。但是，由于生育、授乳等因素的影响，女性的病情往往较重，特别是易发生骨质疏松软化，而男性则以骨质硬化为主。